1976年美国学者提出的医患关系基本模式是
A. 主动—被动型，互相—合作型，平等参与型
B. 主动—合作型，相互—指导型，共同参与型
C. 主动—配合型，指导—合作型，共同参与型
D. 主动—被动型，指导—合作型，共同参与型
E. 主动—被动型，共同参与型，父权主义型

正确答案：D。主动—被动型，指导—合作型，共同参与型

解析：1976年美国学者提出的医患关系基本模式是①主动—被动型：医生主动命令，病人被动服从；②指导—合作型：医生指导诊疗，病人配合诊疗；③共同参与型：医生帮助病人，病人主动参与诊疗（D对）。